清洁手术（I类切口）预防性应用抗菌药物，可以选用
A. 头孢唑林注射剂
B. 甲硝唑注射剂
C. 头孢噻肟注射剂
D. 阿奇霉素注射剂
E. 头孢拉定片剂

正确答案：A。头孢唑林注射剂

解析：本题考查手术切口预防抗菌药物。一类手术切口属于无菌的手术切口，在围手术期间可预防性的应用抗菌药物，常用药物为第一代头孢菌素，如头孢唑林（A对）。